在十二经脉走向中，足三阴经是
A. 从胸走手
B. 从头走足
C. 从足走胸
D. 从足走腹
E. 从手走头

正确答案：D。从足走腹

解析：十二经脉的循行走向总的规律是足三阴经从足走腹胸（D对）；手三阴经从胸走手（A错），足三阳经从头走足（B错），足三阴经从足走腹胸（C错），手三阳经从手走头（A错）。